胸骨左缘第3肋间舒张期叹气样杂音见于
A. 二尖瓣关闭不全
B. 主动脉瓣关闭不全
C. 主动脉瓣狭窄
D. 肺动脉瓣狭窄
E. 二尖瓣狭窄

正确答案：B。主动脉瓣关闭不全

解析：胸骨左缘第3肋间（主动脉瓣第二听诊区）舒张期叹气样杂音见于主动脉瓣关闭不全（B对）。主动脉瓣关闭不全杂音呈舒张早期开始的递减型柔和叹气样的特点，常向胸骨左缘及心尖传导，于主动脉瓣第二听诊区、前倾坐位、深呼气后暂停呼吸最清楚。二尖瓣关闭不全（A错）可于心尖部闻及全收缩期吹风样杂音。主动脉瓣狭窄（C错）于胸骨右缘第2肋间闻及收缩期粗糙响亮射流样杂音。肺动脉瓣狭窄（D错）于胸骨左缘第2肋间处可听到Ⅲ～Ⅳ级响亮粗糙的喷射性吹风样收缩期杂音。二尖瓣狭窄（E错）的典型体征为心尖部舒张期隆隆样杂音。